男，40岁，烧伤后3小时入院。疼痛剧烈，感口渴。面色苍白，心率150次/min，BP85/65mmHg，头颈部、躯干部布满大小不等水疱，可见潮红创面。两上肢呈焦黄色，无水疱。该病员Ⅲ度烧伤面积各为
A. 1×9%
B. 2×9%
C. 3×9%
D. 4×9%
E. 5×9%

正确答案：B。2×9%

解析：患者烧伤后头颈部、躯干部布满大小不等的水疱，由于有水疱形成，故为Ⅱ°烧伤。两上肢呈焦黄色，无水疱形成，此为Ⅲ°烧伤。根据中国新九分法（P138 表13-1），计算该伤员Ⅲ°烧伤的面积为2×9%（B对）。